患者，男，12岁。患流痰3年，溃口位于左腰部，脓水稀薄，夹有败絮样物质，伴有午后潮热，夜间盗汗，口燥咽干，咳嗽痰血，舌红少苔，脉细数。治疗应首选
A. 阳和汤
B. 知柏地黄丸
C. 清骨散
D. 人参养荣汤
E. 六味地黄丸

正确答案：C。清骨散

解析：该患者年少患流痰3年，溃口位于左腰部，脓水稀薄，夹有败絮样物，年少患此病多见于先天不足。阴虚故见午后潮热，夜间盗汗，口燥咽干，虚火灼肺故见咳嗽痰血，舌红少苔，脉细数亦为阴虚火旺之象，故辨证为阴虚火旺证，治法：养阴清热托毒。用六味地黄丸合清骨散加减，但六味地黄丸侧重养阴，清虚热除骨蒸之功不如清骨散，本患者虚火明显，清骨散为最佳答案（C对）。阳和汤功能温阳补血，散寒通滞，可用于流痰初期阳虚痰凝证（A错）。知柏地黄丸功能滋阴降火，可用于阴部热疮之阴虚邪恋证（B错）。人参养荣汤功能温补气血，可用于流痰后期气血两虚者（D错）。六味地黄丸功能滋阴补肾，可用于瘰疬之阴虚火旺证（E错）。